关于液体制剂质量要求的说法，错误的是
A. 除另有规定外，干混悬剂应进行干燥失重检查
B. 口服乳剂应按规定进行离心试验，不应有分层现象
C. 口服混悬剂放置后若有沉淀物，经振摇应易再分散
D. 口服乳剂包括口服的O/W和W/O液体制剂
E. 口服乳剂可能会出现相分离现象，但经振摇应易再分散

正确答案：D。口服乳剂包括口服的O/W和W/O液体制剂

解析：本题考查的是液体制剂质量要求。口服乳剂不包括口服的O/W和W/O液体制剂（D错，为本题正确答案）。口服乳剂的外观应呈均匀的乳白色，以半径为10cm的离心机每分钟4000转的转速离心15分钟，不应有分层现象（B对）。乳剂可能会出现相分离的现象，但经振摇应易再分散（E对）。口服混悬剂应分散均匀，放置后若有沉淀物，经振摇后易再分散（C对）。口服混悬剂在标签上应注明“用前摇匀”。除另有规定外，干混悬剂照干燥失重测定法，减失重量不得过2.0%（A对）。口服乳剂的定义，2022年考试指南未明确说明。口服乳剂系指两种互不相溶的液体制成的供口服的稳定的水包油型液体制剂。